急性肾小球肾炎症见全身浮肿，尿少，恶心呕吐，口中气秽，头晕头痛，嗜睡，舌苔腻，脉弦，其证型是
A. 风水相搏
B. 毒浸淫
C. 水凌心肺
D. 邪陷心肝
E. 水毒内闭

正确答案：E。水毒内闭

解析：急性肾小球肾炎症见全身浮肿，尿少，为水湿之邪停留于内的表现；恶心呕吐，口中气秽，头晕头痛，嗜睡，为毒邪内闭的症状；综合辨证为水毒内闭（E对）。风水相搏证，主要症状有恶寒发热，咳嗽气短，面部浮肿，或全身水肿，皮色光泽等（A错）。毒浸淫证，主要表现为皮肤疮毒未愈，面部或全身水肿，口干口苦，尿少色赤，甚则血尿（B错）。水凌心肺证，主要症状有肢体浮肿，呛咳，气急，心悸，胸闷，口唇青紫（C错）。急性肾小球肾炎病位主要在脾肾两脏，一般没有邪陷心肝的证型，另一方便邪陷心肝主要表现为心烦，失眠，口苦，烦躁等表现（D错）。